急性肾小球肾炎最常见的临床表现为
A. 咽痛、蛋白尿、水肿、血浆白蛋白下降
B. 蛋白尿、血尿、心功能不全
C. 血尿、蛋白尿、水肿、高血压
D. 血尿、肾区叩痛、发热
E. 血尿、蛋白尿、尿路刺激征

正确答案：C。血尿、蛋白尿、水肿、高血压